上消化道出血止血可选用
A. 肾上腺素
B. 去甲肾上腺素
C. 异丙肾上腺素
D. 多巴胺
E. 麻黄碱

正确答案：B。去甲肾上腺素

解析：去甲肾上腺素主要用于早期神经源性休克以及嗜铬细胞瘤切除后或药物中毒时的低血压。食道静脉曲张破裂出血或胃出血时，取本品适当稀释后口服，可收缩食道或胃局部黏膜血管产生止血效果（B对）。